麻疹无并发症，应隔离的时间是出疹后
A. 3天
B. 5天
C. 7天
D. 10天
E. 14天

正确答案：B。5天

解析：麻疹预防：易感儿进行麻疹减毒活疫苗预防接种，有明显麻疹接触史者，5天之内应及时注射丙种球蛋白0.25mg/kg，可预防发病，若使用量不足或接触麻疹5天之后使用，仅可减轻症状。被动疫苗只可维持3～8周，以后应采取主动疫苗；麻疹流行期间，避免去公共场所及探亲访友。对麻疹患者做到早诊断、早报告、早治疗。患儿隔离至出疹后5天（B对），并发肺炎者，延长隔离至出疹后10天。